容易通过被动扩散透过胎盘屏障的药物特点是
A. 分子量大、弱碱性
B. 弱酸性、蛋白结合率低、半衰期长
C. 脂溶性高、分子量小
D. 蛋白结合率高，具有手性、分布容积大
E. 蛋白结合率高、分子量大

正确答案：C。脂溶性高、分子量小

解析：本题考查胎盘转运。药物经胎盘转运特点有：①多数药物以被动扩散的形式透过胎盘。②与胎盘表面积成正比，与胎盘内膜厚度成反比。③脂溶性高、分子量小、解离度高、蛋白结合低的药物容易透过（C对）。④弱碱性药物在胎儿体内浓度可比母体高。